推动人体生长发育及脏腑功能活动的气是
A. 元气
B. 宗气
C. 营气
D. 卫气
E. 中气

正确答案：A。元气

解析：本题考查人体之气的分类及其功能，属于记忆内容。元气的生理功能主要有两个方面，一是推动和调节人体的生长发育和生殖机能，二是推动和调控各脏腑、经络、形体、官窍的生理活动（A对）。宗气的生理功能主要有行呼吸、行血气和资先天三个方面（B错）。营气的生理功能有化生血液和营养全身两个方面（C错）。卫气有防御外邪、温养全身和调控腠理的生理功能（D错）。“中气”是脾胃二气的合称，是升降协调的冲和之气，其气下陷主要责之脾气不升，故中气下陷也称为脾气下陷（E错）。